膀胱三角
A. 位于膀胱颈内面
B. 膀胱三角由两个输尿管门和尿道外门围成
C. 输尿管间襞在膀胱镜检时，为一苍白带
D. 男、女性膀胱三角内均有膀胱垂
E. 无

正确答案：C。输尿管间襞在膀胱镜检时，为一苍白带

解析：膀胱三角位于膀胱底内面（A错），左、右输尿管口和尿道内口之间（B错）。输尿管间襞为两个输尿管口之间的皱襞，膀胱镜下所见为一苍白带（C对）。膀胱垂（D错）是男性膀胱三角的特殊结构。